人类目前常用的化学物质有多少种
A. 300万
B. 6万~7万
C. 40万
D. 100万
E. 15万

正确答案：B。6万~7万